下列哪项是决定牙形状的重要因素
A. 成釉器
B. 牙乳头
C. 牙囊
D. 外胚间充质
E. 牙板

正确答案：B。牙乳头

解析：本题考查决定牙形状的重要因素。牙乳头是决定牙形状的重要因素（B对），形成牙髓和牙本质。成釉器形成釉质（A错）。牙囊形成牙骨质、牙周膜和固有牙槽骨（C错）。外胚间充质为牙乳头和牙囊的组织来源（D错）。在帽状期时牙板与成釉器有广泛联系，钟状期末逐渐断裂、退化、消失（E错）。